急性阑尾炎热毒证者宜用
A. 大黄牡丹皮汤合红藤煎加减
B. 大柴胡汤
C. 大黄牡丹皮汤合透脓散加减
D. 大陷胸汤
E. 龙胆泻肝汤

正确答案：C。大黄牡丹皮汤合透脓散加减

解析：总的病机为气滞、血瘀、湿阻、热壅，进而热毒炽盛，结于阳明或侵入营血，严重者可致阴竭阳脱之危候。急性阑尾炎热毒证者宜用大黄牡丹皮汤合透脓散加减急性阑尾炎（C对）。急性阑尾炎瘀滞证者宜用大黄牡丹皮汤合红藤煎加减（A错）。大柴胡汤主治少阳阳明合病。往来寒热，胸胁苦满，呕不止，郁郁微烦，心下痞硬，或心下满痛，大便不解，或协热下利（B错）。大陷胸汤主治水热互结之结胸证。心下疼痛，拒按，按之硬，或从心下至少腹硬满疼痛，手不可近（D错）。龙胆泻肝汤主治肝胆实火上炎证。头痛目赤，胁痛，口苦，耳聋，耳肿（E错）。